不属于肉瘤特征的是
A. 间质结缔组织少
B. 瘤细胞呈巢状
C. 多经血行转移
D. 切面呈鱼肉状
E. 瘤组织内血管丰富

正确答案：B。瘤细胞呈巢状

解析：肉瘤是指起源于间叶组织的恶性肿瘤，肉眼观体积常较大，切面多呈鱼肉状（D对），镜下，瘤细胞大多不呈巢状（B错，为本题正确答案），而呈弥漫生长，与间质分界不清。间质结缔组织一般较少（A对），但瘤组织内血管丰富（E对），故肉瘤多经血行转移（C对）。